患者，胁肋胀痛，脘腹灼热疼痛，口苦，舌质红，脉弦数。宜首选的药物是
A. 木香
B. 香附
C. 乌药
D. 川楝子
E. 陈皮

正确答案：D。川楝子

解析：患者胁肋胀痛，脘腹灼热疼痛，口苦，舌红，脉弦数，为肝郁化火出现的表现；川楝子苦寒清泄，既能清肝火，又能行气止痛，治疗肝郁化火诸痛证，宜首选川楝子治疗（D对）。木香（A错）的功效是行气止痛，健脾消食。香附（B错）的功效是疏肝解郁，理气宽中，调经止痛。乌药（C错）的功效是行气止痛，温肾散寒。陈皮（E错）的功效是理气健脾，燥湿化痰。